《药品经营质量管理规范》应具体负责企业质量管理工作的是
A. 药品零售企业主要负责人
B. 药品零售企业专职质量管理人员
C. 药品零售企业中处方审核人员
D. 药品零售企业质量负责人
E. 药品零售企业法定代表人

正确答案：B。药品零售企业专职质量管理人员

解析：本题考查企业专职质量管理人员。《药品经营质量管理规范》应具体负责企业质量管理工作的是药品零售企业专职质量管理人员（B对）。依据《药品经营质量管理规范》第一百二十六条，企业应当设置质量管理部门或者配备质量管理人员，履行以下职责：（1）督促相关部门和岗位人员执行药品管理的法律法规及本规范；（2）组织制订质量管理文件，并指导、监督文件的执行；（3）负责对供货单位及其销售人员资格证明的审核；（4）负责对所采购药品合法性的审核；（5）负责药品的验收，指导并监督药品采购、储存、陈列、销售等环节的质量管理工作；（6）负责药品质量查询及质量信息管理；（7）负责药品质量投诉和质量事故的调查、处理及报告；（8）负责对不合格药品的确认及处理；（9）负责假劣药品的报告；（10）负责药品不良反应的报告；（11）开展药品质量管理教育和培训；（12）负责计算机系统操作权限的审核、控制及质量管理基础数据的维护；（13）负责组织计量器具的校准及检定工作；（14）指导并监督药学服务工作；（15）其他应当由质量管理部门或者质量管理人员履行的职责。